胎头于临产后迟迟不入盆，骨盆测量径线最有价值的是
A. 髂棘间径
B. 髂嵴间径
C. 骶耻外径
D. 坐骨棘间径
E. 对角径

正确答案：C。骶耻外径

解析：胎头于临产后迟迟不入盆，说明入口平面狭窄，入口平面狭窄以骨盆入口平面前后径狭窄为主，由于骶耻外径（C错）值减去1/2尺桡周径值即骨盆入口前后径的值，现已不常规测量，此题无答案。对角径（P147）（E错）测量的是骶岬上缘中点到耻骨联合下缘的距离，对角径减去1.5～2cm为骨盆入口前后径的长度，但是对角径的测量是骨盆内测量，近预产期测量容易引起感染，临产后不能做骨盆内测量。髂棘间径（P146）（A错）测量的是两髂前上棘外缘的距离，髂嵴间径（P146）（B错）测量的是髂嵴外缘最宽的距离，均与入口平面狭窄关系不大。坐骨棘间径（P148）（D错）是中骨盆最短的径线，此径线过小会影响分娩过程中胎头的下降，不影响胎头入盆。